毒物是
A. 动植物中的天然毒素以及有毒的矿物质
B. 对大鼠经口LD₅₀﹥500mg/kg的物质
C. 凡能对机体产生功能和/或器质损害的物质
D. 具有致畸、致癌、致突变效应的物质
E. 一定条件下较小剂量即能对机体产生损害的物质

正确答案：E。一定条件下较小剂量即能对机体产生损害的物质